一般认为中心体温为（）摄氏度是高温作业工人生理应激范围的上限。
A. 35
B. 36
C. 37
D. 38

正确答案：D。38

解析：本题考查高温作业制定标准。高温作业卫生标准的制订时一般参考WBGT，高温作业时，人体与环境的热交换和平衡受到气象因素及劳动代谢产热的影响。制订卫生标准应以机体热应激不超出生理范围（例如，直肠体温≤38℃（D对ABC错））为依据，对气象诸因素及劳动强度作出相应的规定，以保证劳动者的健康。